津液输布的通道是
A. 经络
B. 腠理
C. 血府
D. 三焦
E. 分肉

正确答案：D。三焦

解析：全身津液的输布和排泄，是在肺、脾、肾等脏腑的协同作用下完成的，但必须以三焦为通道。三焦水道不利，肺、脾、肾等脏腑输布调节津液代谢的功能则难以实现。三焦具有疏通水道、运行津液的作用，以调节津液代谢平衡（D对）。